根据《关于进一步改革完善药品生产流通使用政策的若干意见》，药品使用环节重大改革强调的是
A. 整顿流通秩序，推进药品流通体制改革
B. 提高药品质量疗效，促进医药产业结构调整
C. 深化医药卫生体制改革，推进健康中国建设
D. 调整利益驱动机制，规范医疗和用药行为

正确答案：D。调整利益驱动机制，规范医疗和用药行为

解析：本题考查的是药品供应保障制度。根据《关于进一步改革完善药品生产流通使用政策的若干意见》，药品使用环节重大改革强调的是调整利益驱动机制，规范医疗和用药行为（D对）。药品供应保障制度：（一）完善药品供应保障制度的总体要求：改革完善药品生产流通使用政策，推进实施药品生产流通使用全流程改革，健全药品供应保障制度，是习近平总书记提出的“健康中国”国家战略重点任务之一，是深化医药卫生体制改革、推进健康中国建设（C错）的重要内容。（二）药品研制政策与改革措施：国家鼓励研究和创制新药，保护公民、法人和其他组织研究、开发新药的合法权益。（三）药品生产政策与改革措施：生产环节关键是提高药品质量疗效，促进医药产业结构调整（B错）。（四）药品流通政策与改革措施：流通环节重点是整顿流通秩序，推进药品流通体制改革（A错）。（五）药品使用政策与改革措施：使用环节改革强调调整利益驱动机制，规范医疗和用药行为。（六）药品储备与供应政策与改革措施：为保证灾情、疫情及突发事故发生后对药品和医疗器械的紧急需要，国家于20世纪70年代初建立了国家医药储备制度，20世纪90年代建立了中央和地方两级医药储备制度。